脾动脉的分支分布于
A. 胃、肝、脾
B. 胃、脾、胰
C. 胰、脾
D. 胃、十二指肠、脾
E. 脾、胃底、左肾上腺

正确答案：B。胃、脾、胰

解析：胃、脾、胰（B对）为脾动脉的分支分布部位。胃后动脉、胃短动脉分布于胃底，胃网膜左动脉分布于胃大弯侧的胃壁和胃网膜，脾支分布于脾，胰支分布于胰体和胰尾。